在感染过程的5种结局中最不常见的表现是
A. 病原体被清除
B. 隐性感染
C. 显性感染
D. 病原携带状态
E. 不感染

正确答案：C。显性感染